女，68岁。突发上腹阵发性绞痛2小时，短时间内寒战、高热，小便呈浓茶样，随后嗜睡。查体：T39.6℃，P128次/分，R30次/分，BP80/50mmHg。神志不清，躁动，巩膜黄染，右上腹肌紧张，有压痛和反跳痛。导致该患者所患疾病最可能的病因是
A. 胆管肿瘤
B. 胆管结石
C. 胆管蛔虫
D. 胆管狭窄
E. 胆管畸形

正确答案：B。胆管结石

解析：老年女性患者，上腹绞痛，寒战高热，巩膜黄染（黄疸），血压80/50mmHg（休克），神志不清、躁动（中枢神经系统抑制现象），为典型的Reynolds五联征，应诊断为急性梗阻性化脓性胆管炎（AOSC）。在我国，导致急性梗阻性化脓性胆管炎最可能的病因是胆管结石（B对）。胆管肿瘤（A错）、胆管蛔虫病（C错）、胆道狭窄（D错）、胆管畸形（E错）均是AOSC的病因，但均不如胆管结石常见。